患者，女，35岁，胁痛反复发作5年，加重3天。现症见：胁肋胀痛，走窜不定，胸闷腹胀，舌苔薄白，脉弦，其证是
A. 肝郁脾虚证
B. 肝胃不和证
C. 肝郁气滞证
D. 肝胆湿热证
E. 肝洛失养证

正确答案：C。肝郁气滞证

解析：根据患者“胁痛反复发作5年，加重3天”，辨为“胁痛”；根据“胁肋胀痛，走窜不定，胸闷腹胀，舌苔薄白，脉弦”，辨为“肝郁气滞证”（C对）。患者肝失条达，气机郁滞，络脉失和，治宜疏肝理气，柔肝止痛，方选柴胡疏肝散加减。